队列研究的观察终点是
A. 观察对象出现了预期的结果
B. 观察对象因非研究因素退出研究
C. 观察任务研究完成
D. 观察对象死于车祸等意外
E. 随访者与观察对象失去了联系

正确答案：A。观察对象出现了预期的结果

解析：观察终点：研究对象出现了预期的结局（A对）就达到了观察终点，之后将不再对其继续随访。未达到观察终点而脱离随访的情况称为失访。例如，某研究对象死于非研究疾病就应视为失访。